具有神经氨酸酶抑制作用的抗流感病毒药物是
A. 阿昔洛韦
B. 拉米夫定
C. 依法韦仑
D. 奥司他韦
E. 沙奎那韦

正确答案：D。奥司他韦

解析：本题考查非核苷类抗病毒药。奥司他韦（D对）可抑制神经氨酸酶，通过抑制NA，阻断流感病毒的复制，能够有效地治疗和预防流感。阿昔洛韦（A错）为抗疱疹病毒药。拉米夫定（B错）为抗乙型肝炎病毒药。依法韦仑（C错）为抗艾滋病毒的特效药物。沙奎那韦（E错）是第一个上市的治疗艾滋病的蛋白酶抑制剂。